氟斑牙多见于
A. 恒牙
B. 切牙
C. 年轻恒牙
D. 磨牙
E. 乳牙

正确答案：A。恒牙

解析：本题考查氟斑牙的临床表现。氟斑牙多见于恒牙（A对），发生在乳牙（E错）者甚少。氟牙症的临床表现是同一时期萌出牙的牙釉质上有白垩色到褐色的斑块，严重者还并发牙釉质的实质缺损。由于是发生于同一时期萌出牙，并不单指切牙（B错）、磨牙（D错）、年轻恒牙（C错）等。